全口义齿人工牙排列要有平衡（牙合）的主要原因为
A. 使咀嚼效率更高
B. 使上下颌牙接触面积更广
C. 使义齿看起来美观
D. 使牙槽嵴受力更均匀
E. 使义齿稳定

正确答案：E。使义齿稳定

解析：本题考查全口义齿平衡（牙合）的作用。全口义齿平衡（牙合）指在正中（牙合）位下颌作前伸（牙合）、侧方（牙合）等非正中运动时，上下颌相关的牙都能接触，以保证义齿在功能时的固位和稳定（E对）。提高咀嚼效率（A错）通过使用解剖式牙，达到最广泛的尖窝接触关系来实现。平面（牙合）是平面接触，但线性（牙合）平面和线的接触关系，却更易获得平衡（牙合），所以接触面积大小（B错）不是重点。有时为了实现平衡（牙合），会使用非解剖式牙，并不利于美观（C错）。平衡（牙合）的目的是为了使（牙合）力以垂直方向向牙槽嵴传导，减少侧向力，保持义齿稳定,而不是使牙槽嵴受力更均匀（D错）。